类风湿关节炎，常表现为
A. 指关节梭状畸形
B. 杵状指
C. 匙状甲
D. 浮髌现象
E. 肢端肥大

正确答案：A。指关节梭状畸形

解析：类风湿关节炎，常表现为指关节梭状畸形（A对）。杵状指常见于慢性肺脓肿、支气管扩张、支气管肺癌、发绀型先天性心脏病、亚急性感染性心内膜炎、肝硬化等，故支气管扩张，常表现为杵状指（B错）。匙状甲（C错）又称反甲，常见于缺铁性贫血和高原疾病，偶见于风湿热及甲癣。浮髌现象阳性提示中等量以上关节积液（50ml）（D错）。肢端肥大是因生长激素分泌过多所致，见于巨人症（E错）。